既化痰止咳，又和胃降逆的药是
A. 紫菀
B. 紫苏子
C. 枇杷叶
D. 枳实
E. 柿蒂

正确答案：C。枇杷叶

解析：本题考查的是枇杷叶的功效。既化痰止咳，又和胃降逆的药是枇杷叶（C对）。枇杷叶：【功效】清肺止咳，降逆止呕。枇杷叶则兼润肺燥，善治燥咳；又能和胃降逆止呕，治胃热呕吐。紫菀（A错）：【功效】润肺下气，化痰止咳。紫苏子（B错）：【功效】降气化痰，止咳平喘，润肠通便。枳实（D错）：【功效】破气消积，化痰除痞。柿蒂（E错）：【功效】降气止呃。